小儿热量的主要来源是
A. 脂肪
B. 蛋白质
C. 糖
D. 维生素
E. 矿物质

正确答案：C。糖

解析：营养素包括水、蛋白质、脂肪、糖类、维生素、矿物质等。糖类是供给机体热能的主要来源，其供热量约占总热量的50%～60%（C对）。脂肪（A错）是体内重要的供能物质，并有利于脂溶性维生素的吸收，防止体热散失，保护脏器不受损伤，饮食中脂肪供给的热量约占总能量的35%～50%，年长儿约为25%～30%。蛋白质（B错）是构成人体组织细胞的重要组成部分，能促进机体生长，补充机体的消耗，供给部分热能，婴儿蛋白质每日需要量约2～4g/kg，其供能约占总能量的8%～15%；1岁以后蛋白质需要量逐渐减少，直到成人的每日1.1g/kg。维生素（D错）和矿物质（E错）是维持机体正常代谢和生理功能所必需的一大类有机化合物的总称。其不产生能量，人体需要量甚微，但体内不能合成或合成量不足，必须由食物供给。